根据《中华人民共和国药品管理法》及其实施条例，关于药品生产监督管理的说法，正确的有
A. 经省、自治区、直辖市人民政府药品监督管理部门批准，药品生产企业可以接受委托生产药品
B. 通过《药品生产质量管理规》认证的药品生产企业可以接受委托生产疫苗、血液制品
C. 药品生产企业变更《药品生产许可证》许可事项，应在许可事项发生变更30日前申请变更登记
D. 药品生产企业新增生产剂型的，应按照规定申请《药品生产质量管理规范》认证
E. 药品生产企业终止生产药品或者关闭的，其《药品生产许可证》由原发证部门缴销

正确答案：C、D、E。药品生产企业变更《药品生产许可证》许可事项，应在许可事项发生变更30日前申请变更登记；药品生产企业新增生产剂型的，应按照规定申请《药品生产质量管理规范》认证；药品生产企业终止生产药品或者关闭的，其《药品生产许可证》由原发证部门缴销

解析：本题考查药品生产企业管理。根据《中华人民共和国药品管理法》及其实施条例，关于药品生产监督管理的说法，正确的有药品生产企业变更《药品生产许可证》许可事项，应在许可事项发生变更30日前申请变更登记（C对）；药品生产企业新增生产剂型的，应按照规定申请《药品生产质量管理规范》认证（D对）；药品生产企业终止生产药品或者关闭的，其《药品生产许可证》由原发证部门缴销（E对）。《中华人民共和国药品管理法实施条例》第二章药品生产企业管理第四条：药品生产企业变更《药品生产许可证》许可事项的，应当在许可事项发生变更30日前，向原发证机关申请《药品生产许可证》变更登记；未经批准，不得变更许可事项。原发证机关应当自收到申请之日起15个工作日内作出决定。第六条：新开办药品生产企业、药品生产企业新建药品生产车间或者新增生产剂型的，应当自取得药品生产证明文件或者经批准正式生产之日起30日内，按照规定向药品监督管理部门申请《药品生产质量管理规范》认证。受理申请的药品监督管理部门应当自收到企业申请之日起6个月内，组织对申请企业是否符合《药品生产质量管理规范》进行认证；认证合格的，发给认证证书。第八条：《药品生产许可证》有效期为5年。有效期届满，需要继续生产药品的，持证企业应当在许可证有效期届满前6个月，按照国务院药品监督管理部门的规定申请换发《药品生产许可证》。药品生产企业终止生产药品或者关闭的，《药品生产许可证》由原发证部门缴销。第十条：依据《药品管理法》第十三条规定，接受委托生产药品的，受托方必须是持有与其受托生产的药品相适应的《药品生产质量管理规范》认证证书的药品生产企业（A错）。疫苗、血液制品和国务院药品监督管理部门规定的其他药品，不得委托生产（B错）。